机体对环境变化的适应性是
A. 人类固有的、无限的
B. 人类固有的、有限的
C. 在长期发展的进程中与环境相互作用所形成的、无限的
D. 在长期发展的进程中与环境相互作用所形成的、有限的
E. 与疾病的发生无关的

正确答案：D。在长期发展的进程中与环境相互作用所形成的、有限的

解析：本题考查机体对环境变化的适应性。机体对环境变化的适应性是在长期发展的进程中与环境相互作用所形成的、有限的（D对ABCE错）。